脂酰CoA的生成中脂肪动员的主要产物是
A. 脂酰CoA合成酶
B. 乙酰CoA
C. 丙酮
D. 辅酶A
E. 游离脂肪酸

正确答案：E。游离脂肪酸

解析：脂肪酸的活化——脂酰CoA的生成，脂肪动员的主要产物是游离脂肪酸。它在氧化分解前需先在胞液中的内质网或线粒体外膜上活化成活泼的脂酰CoA才能进一步转变。催化此反应的酶为脂酰CoA合成酶，反应需消耗ATP。掌握“脂肪的分解代谢”知识点。